男，60岁。活动时胸痛1年，胸痛发作时休息5分钟左右即可自行缓解。既往糖尿病病史10年，实验室检查：LDL-C3.52mno/L，冠脉造影示左冠状动脉回旋支近段狭窄80%。该患者控制LDL-C的目标是低于
A. 1.81mmol/L
B. 2.07mmol/L
C. 2.59mmol/L
D. 4.14mmol/L
E. 3.37mmol/L

正确答案：A。1.81mmol/L

解析：患者中老年男性，活动时胸痛1年，胸痛发作时休息5分钟左右即可自行缓解（稳定性心绞痛典型表现）。糖尿病病史10年，冠脉造影示左冠状动脉回旋支近段狭窄80%（提示冠脉供血不足）。实验室检查：LDL-C3.52mmo/L（升高，正常为2.7mmol/L）。结合患者临床表现及影像学检查，易诊断为稳定型心绞痛。所有明确诊断冠心病病人，无论其血脂水平如何，均应给予他汀类药物，并将LDL-C降至1.8mmol/L以下水平（A对）。